某男，58岁。腰脊酸软，尿后余沥，小便频数，滑精早泄，听力减退；舌淡苔白，脉细弱。辨析其证候是
A. 肾阳虚
B. 肾阴虚
C. 肾气不固
D. 肾精不足
E. 心肾不交

正确答案：C。肾气不固

解析：本题考查的是肾气不固证临床表现及辨证要点。某男，58岁。腰脊酸软，尿后余沥，小便频数，滑精早泄，听力减退；舌淡苔白，脉细弱。辨析其证候是肾气不固（C对）。肾气不固证的临床表现，常见滑精早泄，尿后余沥，小便频数而清，甚则不禁，腰脊酸软，面色淡白，听力减退，舌淡苔白，脉细弱。一般以肾及膀胱不能固摄表现的症状为辨证要点。肾阳虚（A错）证的临床表现，常见形寒肢冷，精神不振，腰膝酸软，或阳痿不举，舌淡苔白，脉沉迟或两尺无力。一般以全身功能低下伴见寒象为辨证要点。肾阴虚（B错）证的临床表现，常见头晕目眩，耳鸣耳聋，牙齿松动，失眠遗精，口燥咽干，五心烦热，盗汗，腰膝酸痛，舌红，脉细数。一般以肾病的主要症状和阴虚内热症状同见为辨证要点。肾精不足（D错）证的临床表现，常见男子精少不育，女子经闭不孕，性功能减退。小儿发育迟缓，身材矮小，智力和动作迟钝，囟门迟闭，骨骼痿软。成人早衰，发脱齿摇，耳鸣耳聋，健忘恍惚，动作迟缓，足痿无力，精神呆钝等。一般以小儿生长发育迟缓、成人早衰、生殖功能减退的表现为辨证要点。心肾不交（E错）证的临床表现，常见虚烦失眠，心悸健忘，头晕耳鸣，咽干，腰膝酸软，多梦遗精，潮热盗汗，小便短赤，舌红无苔，脉细数。心阴虚，神失所养，故见虚烦失眠、心悸健忘。肾阴虚，则腰膝酸软。肾之阴精不足，不能上养清窍，故见头晕耳鸣。虚火内扰、精关不固，则多梦遗精。潮热盗汗、咽干、小便短赤、舌红无苔、脉细数，均属阴虚内热之象。一般以失眠，伴见心火亢而肾水虚的症状为辨证要点。